急性脓胸最常继发于
A. 肺部感染
B. 胸部开放性损伤
C. 膈下脓肿
D. 脓毒血症
E. 胸外科手术后

正确答案：A。肺部感染

解析：脓胸的致病菌多来自肺内感染灶，也有少数来自胸内和纵隔内其他脏器或身体其他部位病灶，直接或经淋巴侵入胸膜引起感染化脓；继发于脓毒血症或败血症的脓胸，则多通过血行播散。感染方式包括外伤、手术污染：膈下、肝、纵隔的脓肿，化脓性心包炎等，经淋巴管侵入；血源性播散。故选A。掌握“脓胸”知识点。